中毒型菌痢与普通型菌痢最主要的鉴别点为
A. 发热与腹泻间隔时间的长短
B. 是否有感染性休克或中毒性脑病
C. 体温的高低
D. 脓血样大便的程度
E. 腹泻次数的多少

正确答案：B。是否有感染性休克或中毒性脑病

解析：普通型菌痢起病急，高热可伴发冷寒战，随后出现腹痛、腹泻和里急后重，每日排便十余次至数十次，量少。初始为稀便，可迅速转为 黏液脓血便，左下腹压痛及肠鸣音亢进。中毒型菌痢休克型表现为 感染中毒性休克，脑型主要表现为中毒性脑病，以中枢神经系统症状为主要临床表现。因此，是否有感染性休克或中毒性脑病（B对）为两者主要鉴别点；中毒型菌痢与普通型菌痢发热在腹泻间隔时间的长短（A错）、体温的高低（C错）、脓血样大便的程度（D错）、腹泻次数的多少（E错）等方面无明显特征性区别，二者均可出现上述症状。